某女，55岁。患冠心病心绞痛，症见胸痛胸闷，心悸气短，脉结代，证属气阴两虚、瘀血阻脉，医师处以益心舒胶囊，服药后症状缓解，此因该成药除活瘀外，又能
A. 益气复脉，养阴生津
B. 益气强心，清心安神
C. 益气养阴，清心安神
D. 益气强心，养阴生津
E. 益气复脉，平肝安神

正确答案：A。益气复脉，养阴生津

解析：本题考查的是益心舒胶囊的功能。某女，55岁。患冠心病心绞痛，症见胸痛胸闷，心悸气短，脉结代，证属气阴两虚、瘀血阻脉，医师处以益心舒胶囊，服药后症状缓解，此因该成药除活瘀外，又能益气复脉，养阴生津（A对）。益心舒胶囊：【功能】益气复脉，活血化瘀，养阴生津。参松养心胶囊：【功能】益气养阴，活血通络，清心安神（C错）。